中医的子肠是指
A. 阴道
B. 子宫
C. 子宫口
D. 输卵管
E. 卵巢

正确答案：A。阴道

解析：阴道为性交器官，古人称之为子肠、产道（A对）。子宫（B错）古人称之为女子胞等。子宫口（C错）又被称为子门、子户。输卵管（D错）、卵巢（E错）在古籍上未见中医名称的具体记载。